虚烦不眠，心悸盗汗，头目眩晕，咽干口燥，脉弦细者，治疗应选用
A. 天王补心丹
B. 归脾汤
C. 酸枣仁汤
D. 朱砂安神丸
E. 左归丸

正确答案：C。酸枣仁汤

解析：患者虚烦不眠，心悸盗汗，头目眩晕，咽干口燥，脉弦细。由肝血不足，阴虚内热而致。方用酸枣仁汤。酸枣仁养血补肝，宁心安神；茯苓宁心安神；知母清热除烦，川芎调肝血而疏肝气；甘草和中缓急，调和诸药（C对）。天王补心丹方证由忧愁思虑太过，暗耗阴血，使心肾两亏，阴虚血少，虚火内扰所致。为治疗心肾阴血亏虚所致神志不安的的常用方（A错）。归脾汤方证因思虑过度，劳伤心脾，气血亏虚所致。为治疗心脾气血两虚的常用方（B错）。朱砂安神丸方证因心火亢盛，灼伤阴血所致。为治疗心火亢盛，阴血不足而神志不安的常用方（D错）。左归丸方证因真阴不足，精髓亏损所致。为治疗真阴不足的常用方（E错）。